下列关于人初乳的描述，正确的是
A. 糖含量最高
B. 脂肪含量最少而蛋白质含量最多
C. 蛋白质含量较低
D. 脂肪含量最高
E. 蛋白质、糖及脂肪含量均最低

正确答案：B。脂肪含量最少而蛋白质含量最多

解析：初乳指产后7日内分泌的乳汁，含蛋白质最多，脂肪和乳糖含量最少（B对E错）。接下来4周内初乳逐步变为成熟乳，蛋白质含量较低（C错）、糖含量最高（A错）及脂肪含量最高（D错）。